来源于双子叶植物根的药材，横切面特征有
A. 自中心向外的放射状结构
B. 形成层环多明显
C. 皮部占横切面的绝大部分
D. 中心常无髓
E. 最外层常为表皮

正确答案：A、B、D。自中心向外的放射状结构；形成层环多明显；中心常无髓

解析：本题考查的是根类中药的性状鉴定。来源于双子叶植物根的药材，横切面特征有自中心向外的放射状结构（A对）、形成层环多明显（B对）与中心常无髓（D对）。观察根的横断面或横切面特征，首先应注意区分双子叶植物的根和单子叶植物的根：一般双子叶植物的根有自中心向外的放射状结构，木部尤为明显；形成层环大多明显，环内的木部较环外的皮部大（C错）；中心常无髓；外表常有栓皮（E错）。单子叶植物的根横断面自中心向外无放射状结构；内皮层环较明显；中央有髓；外表无木栓层，有的具较薄的栓化组织。其次，应注意根的断面组织中有无分泌组织散布，如伞形科植物当归、白芷均有黄棕色油点。还应注意少数双子叶植物根的异常构造，如何首乌皮部异形维管束形成的“云锦状花纹”，商陆的异形维管束形成数个突起的同心环，习称“罗盘纹”等。